铅吸收是指尿铅含量
A. 超过正常值上限，且有铅中毒的临床表现
B. 不超过正常值上限，且有铅中毒的临床表现
C. 超过正常值上限，无铅中毒的临床表现
D. 不超过正常值上限，无铅中毒的临床表现
E. 以上都不是

正确答案：C。超过正常值上限，无铅中毒的临床表现